细胞窒息性气体
A. 一氧化碳
B. 二甲苯
C. 氰化物
D. 二氧化硫
E. 二氧化碳

正确答案：C。氰化物

解析：本题考查细胞窒息性气体的概念。细胞窒息性气体是指一类能抑制细胞内呼吸酶活性，阻碍细胞对氧的摄取和利用，从而发生细胞“内窒息”的气体。如硫化氢、氰化氢（C对ABDE错）等。